在制定环境质量标准时，应重点考虑的人群是
A. 老年人
B. 青年人
C. 正常人群
D. 健康人群
E. 敏感人群

正确答案：E。敏感人群

解析：本题考查制定环境质量标准应重点考虑的人群。在制定环境质量标准时，应重点考虑的人群是敏感人群（E对ABCD错）。敏感人群包括儿童、老年人、孕妇、患有慢性疾病的人等，他们的身体抵抗力较弱，更容易受到环境污染的影响，因此，在制定环境质量标准时，应该特别重视敏感人群的需求。